迎香穴位于
A. 鼻孔外缘，旁开0.5寸
B. 鼻翼外缘，旁开0.5寸
C. 鼻翼外缘中点旁，鼻唇沟中
D. 鼻翼上缘中点，旁开0.5寸
E. 平鼻孔，当鼻唇沟中

正确答案：C。鼻翼外缘中点旁，鼻唇沟中

解析：迎香穴在面部，鼻翼外缘中点旁，鼻唇沟中（C对）。